骨折后的24～72小时内可出现的是
A. 血管扩张
B. 血浆渗出
C. 炎细胞浸润
D. 出现中性粒细胞
E. 以上均是

正确答案：E。以上均是

解析：骨折后的24～72小时内，骨折周围软组织的急性炎性反应不断加重，血管扩张，血浆渗出，炎细胞浸润，出现中性粒细胞、组织细胞和肥大细胞，开始吞噬和清除坏死组织。掌握“颧骨及颧弓、眼眶骨折及骨折愈合过程”知识点。